减张缝合拆除时间是术后
A. 4天
B. 5～6天
C. 7～9天
D. 10～12天
E. 14天

正确答案：E。14天

解析：减张缝线需14天以上拆线（E对）。一般头、面、颈部切口在术后4～5天拆线（A错）。下腹部、会阴部切口6～7天拆线（B错）。胸部、上腹部、背部、臀部切口术后7～9天拆线（C错）。四肢切口在手术10～12天拆线（D错）。